传染病三角包含的三大因素是
A. 宿主、环境和病原体
B. 机体、生物环境和社会环境
C. 宿主、环境和病因
D. 遗传、环境和社会
E. 遗传、环境和人群

正确答案：A。宿主、环境和病原体

解析：本题考查传染性疾病流行的三角模型。传染性疾病流行的三角模型包括：宿主、病原体和环境（A对BCDE错），三者对传染病的流行缺一不可，其关系可用一个等边三角形的平衡关系来描述，表明它们之间相互平等、相互关联和相互制约的关系。